新斯的明的药理作用是
A. 激活胆碱酯酶
B. 激动M受体
C. 抑制胆碱酯酶
D. 阻断M受体
E. 激动N受体

正确答案：C。抑制胆碱酯酶

解析：新斯的明与乙酰胆碱酯酶结合后形成的复合物没有活性，水解速度慢，导致内源性乙酰胆碱积累而产生药效，表现为加强骨骼肌的收缩作用。掌握“易逆性抗胆碱酯酶药”知识点。